神经系统中发育最早的器官是
A. 视觉器官
B. 听觉器官
C. 大脑
D. 脊髓
E. 小脑

正确答案：D。脊髓

解析：本题考查脑发育的相关内容。神经系统发育最早，尤其第一年发育速度最快，新生儿为成人的1/3，3岁时重量达到成人的2/3，8岁时接近成人，是儿童心理发育的物质基础。脊髓（D对ABCE错）在胚胎期就开始发育，2岁时与成人近似。